药材断面维管束与较窄的射线相间排列成细密的放射状纹理，称之为
A. 车轮纹
B. 菊花心
C. 筋脉点
D. 罗盘纹
E. 云锦状花纹

正确答案：B。菊花心

解析：本题考查药材断面名称。如“菊花心（B对）”是指药材断面维管束与较窄的射线相间排列成细密的放射状纹理，形如开放的菊花，如黄芪、甘草、白芍等；“车轮纹（A错）”是指药材断面维管束与较宽的射线相间排列成稀疏整齐的放射状纹理，形如古代木质车轮，如防己、青风藤等；牛膝与川牛膝的“筋脉点（C错）”（同心环点状异型维管束)；何首乌的“云锦状花纹（E错）”（皮部异型维管束）；商陆的“罗盘纹（D错）”（同心环型异型维管束）等，这些特征在鉴别药材时非常有意义。